下列各项，不属于母乳喂养优点的是
A. 母乳中含有最适合婴儿生长发育的各种营养素，易被婴儿消化吸收
B. 母乳中含有丰富的抗体、活性细胞和其他免疫活性物质，可增强婴儿抗感染的能力
C. 母乳中饱和脂肪酸较多，颗粒小、易消化、防腹泻，有利于婴儿脑部发育
D. 母乳温度及泌乳速度适宜，新鲜、无细菌污染
E. 初乳中含丰富的IgA，在胃中不被消化，在肠道中可发挥免疫防御作用

正确答案：C。母乳中饱和脂肪酸较多，颗粒小、易消化、防腹泻，有利于婴儿脑部发育

解析：初乳是指产后7日内分泌的乳汁，因含胡萝卜素呈微黄色，含有较多有形物质。初乳有提高免疫功能、抵御疾病的作用，母乳中含有大量的免疫活性细胞，有多种免疫球蛋白，如IgA、乳铁蛋白、溶菌酶等有吞噬、对抗、抑制病毒和细菌的作用，可避免微生物的侵袭（E对）。母乳喂养是自然界赋予人类的本能够的喂养方法。母乳所含蛋白质、脂肪、乳糖、无机盐、维生素有利于消化吸收（A对）。人乳内所含的白蛋白有2/3是乳蛋白、乳铁蛋白，其中含有大量氨基酸，有利于婴儿生长发育，可增强婴儿抗感染的能力（B对），母乳的不饱和脂肪酸含量高、颗粒小、易消化、防腹泻有益于婴儿神经系统发育，有利于婴儿脑部发育（C错，为本题正确答案）。母乳喂养简便、经济、富含营养且温度适宜（D对）、无细菌污染。